男，30岁。胃溃疡病史3年，1小时前突发上腹痛，症状局限且较轻，确诊为胃溃疡并发穿孔。正确处理为
A. 非手术治疗
B. 单纯穿孔修补术
C. 常规胃大部切除术
D. 全胃切除术
E. 高选择性迷走神经切断术

正确答案：A。非手术治疗

解析：青年男性患者，症状局限且较轻，确诊为胃溃疡穿孔。正确的处理为非手术治疗（A对），适用于临床表现轻，腹膜炎体征趋于局限；空腹穿孔；不属于顽固性溃疡等（八年制第3版外科学）。单纯穿孔修补术（B错）适用于急性胃十二指肠溃疡穿孔，非手术治疗无效或病情加重者。常规胃大部切除术（C错）虽可一次性解决穿孔和溃疡两个问题，但考虑到患者年龄较小、病情较轻，为提高生活质量，故不选择该术式。全胃切除术（D错）主要用于胃癌患者。高选择性迷走神经切断术（E错）为治疗十二指肠溃疡的常用术式，不适用于胃溃疡穿孔。